患者腹部积块明显，质地较硬，固定不移，刺痛，形体消瘦，纳谷减少，面色晦暗黧黑，舌质紫，脉细涩。治疗应首选
A. 逍遥散
B. 六磨汤
C. 柴胡疏肝散合失笑散
D. 膈下逐瘀汤合六君子汤
E. 八珍汤合化积丸

正确答案：D。膈下逐瘀汤合六君子汤

解析：逍遥散为聚证肝气郁结证的选方，功能疏肝解郁，健脾养血（A错）。六磨汤为聚证食滞痰阻证的选方，功能行气化痰，导滞通便（B错）。柴胡疏肝散合失笑散为积证气滞血阻证的选方，两方合用功能理气消积，活血散瘀（C错）。题中患者以腹部积块明显，质地较硬，固定不移为主症，故诊断为积聚，积属有形，结块固定不移，故为积证，瘀血凝结，逐渐加深，故腹部积块明显，质地较硬，固定不移，刺痛，血瘀不能华色，故面色晦暗黧黑，瘀结不消，正气渐损，脾运失健，故形体消瘦，纳谷减少。舌质紫，脉细涩为瘀血内结之象，故辨为瘀血内结证，治宜祛瘀软坚，扶正健脾，方选膈下逐瘀汤合六君子汤（D对）。八珍汤合化积丸为积证正虚瘀结证的选方，两方合用功能补益气血，活血化瘀（E错）。